以下有关复合树脂充填后脱落的原因中，除外的一项是
A. 制备了固位形
B. 湿润的牙面进行酸蚀
C. 充填体过薄
D. 未制备洞斜面
E. 酸蚀后的牙面接触唾液

正确答案：A。制备了固位形

解析：制备了固位形，符合窝洞制备的要求，有利于充填体的固位。掌握“银汞充填术窝洞制备、干燥及充填”知识点。